慢性缩窄性心包炎最常见的病因是
A. 结核性心包炎
B. 急性非特异性心包炎
C. 化脓性心包炎
D. 放射性心包炎
E. 创伤心包炎

正确答案：A。结核性心包炎

解析：慢性缩窄性心包炎常继发于急性心包炎，我国其最常见的病因是结核性心包炎（A对）。急性非特异性心包炎（B错）、化脓性心包炎（C错）、放射性心包炎（D错）、创伤心包炎（E错）都是慢性缩窄性心包炎的病因，但并非最常见病因。